思维是属于心理活动的
A. 意志过程
B. 认知过程
C. 情感过程
D. 人格倾向
E. 人格特征

正确答案：B。认知过程

解析：心理现象分为心理过程和个性特征。心理过程包括认知过程、情感过程与意志过程。意志过程（A错）是有意识地确定目的、克服困难、调节和支配自身的行动：认识过程（B对）包括感觉、知觉、记忆、思维、想象等：情绪情感过程（C错）是产生态度或体验的过程。个性特征包括人格倾向性、人格特征、自我意识系统。人格倾向性（D错）包括需要、动机、兴趣、观点、信念等：人格特征（E错）包括能力、气质、性格：自我意识系统包括自我认识、自我体验、自我调控。